蒲黄的功效是
A. 凉血止血
B. 活血祛瘀
C. 二者均是
D. 二者均不是

正确答案：B。活血祛瘀

解析：本题考查的是蒲黄的功效。蒲黄的功效是活血祛瘀（B对）。蒲黄：【功效】活血祛瘀，收敛止血，利尿通淋。茜草：【功效】凉血，祛瘀，止血（A错），通经。